患者一侧后牙食物嵌塞，嵌塞后引起剧烈疼痛，持续数秒，要求治疗。查：6°龋（是牙合面龋），探敏，叩（一），冷测敏感，不持续，热测同对照牙，该牙诊断应为深龋，治疗应为
A. 磨除法
B. 再矿化
C. 药物治疗
D. 银汞直接充填
E. 垫底，银汞充填

正确答案：E。垫底，银汞充填

解析：本题考查深龋的治疗。该牙诊断应为深龋，治疗应为垫底，银汞充填（E对）。磨除法多用于早期窝沟龋（A错）。再矿化治疗适用于光滑面早期龋（B错）。药物治疗适用于尚未形成龋洞的釉质早期龋、乳牙浅龋或静止龋（C错）。银汞合金为良导体，深龋未垫底直接银汞合金充填，冷热刺激可通过银汞合金传导至牙髓，引起牙髓反应（D错），深龋应先垫底后再行银汞合金充填。